以下哪项不属于患者的权利内容
A. 基本医疗权
B. 知情同意权
C. 人身安全权
D. 保护隐私权
E. 社会免责权

正确答案：C。人身安全权

解析：患者的权利包括：基本医疗权（A对）、知情同意权（B对）、隐私保护权（D对）、经济索赔权、医疗监督权、社会免责权（E对）。不包括人身安全权（C错，为本题正确答案）。